先天缺乏NADH⁻高铁血红蛋白还原酶患者对亚硝酸盐类十分敏感，属于
A. 迟发性毒性作用
B. 过敏性反应
C. 高敏感性
D. 速发性毒性作用
E. 特异体质反应

正确答案：E。特异体质反应